关于体内酶促反应特点的叙述，错误的是
A. 具有高催化效率
B. 温度对酶促反应速度没有影响
C. 可大幅降低反应活化能
D. 只能催化热力学上允许进行的反应
E. 具有可调节性

正确答案：B。温度对酶促反应速度没有影响

解析：温度对酶促反应速率的影响具有双重性（B错，为本题正确答案）。酶作为一种催化剂，具有一般催化剂的特性：①化学反应前后没有质和量的变化；②只能催化热力学允许的化学反应（D对）；③不改变化学反应的平衡点；④通过降低反应的活化能加速反应。酶又具有一般催化剂所没有的特性：①酶对底物具有极高的催化效率（A对）；②酶对底物具有高度的特异性；③酶的活性与酶量具有可调节性（E对）；④酶具有稳定性；⑤酶可大幅降低反应活化能（C对）。